男，45岁。反复腹胀、纳差、牙龈出血2年。进肉食后出现行为异常，胡言乱语12小时。既往体健，否认传染病接触史，无放射性物质接触史，饮酒史20年，每天饮白酒6两左右。无精神病家族史。最可能的诊断是
A. 肝性脑病
B. 食物中毒
C. 尿毒症
D. 急性脑血管病
E. 糖尿病酮症酸中毒

正确答案：A。肝性脑病

解析：患者多年饮酒史，反复腹胀、纳差、牙龈出血，进肉食后出现行为异常，胡言乱语，最可能的诊断是肝硬化基础上的肝性脑病（A对）。食物中毒（B错）有毒物接触史，常为集体发病。尿毒症（C错）有肾脏病变表现。急性脑血管病（D错）常合并高血压（P258）。糖尿病酮症酸中毒（E错）多见于糖尿病。